大隐静脉，下列叙述正确的是
A. 为下肢的深静脉
B. 经内踝后方上行
C. 注入股静脉
D. 注入腘静脉
E. 起自足背静脉弓的外侧部

正确答案：C。注入股静脉

解析：大隐静脉为下肢的浅静脉（A错）。经内踝前方（B错）上行。注入股静脉（C对D错）。大隐静脉在足内侧缘（E错）起自足背静脉弓。